下列哪一种情况不发生乏氧性缺氧？
A. 支气管异物
B. 吸入大量氯气
C. 肺炎
D. CO中毒
E. 法洛四联症

正确答案：D。CO中毒

解析：当吸入气中含有0.1%的CO时，约有50%的血红蛋白与之结合形成HbCO而失去携氧能力，故CO中毒（D错，为本题正确答案）引起的是血液性缺氧。支气管异物（A对）、吸入大量氯气（B对）、肺炎（C对）、法洛四联症（E对）是引起乏氧性缺氧的原因。